味苦性寒，用于杀虫时宜研粉服的药是
A. 榧子
B. 雷丸
C. 贯众
D. 地肤子
E. 鹤草芽

正确答案：B。雷丸

解析：本题考查的是雷丸的用法用量。味苦性寒，用于杀虫时宜研粉服的药是雷丸（B对）。雷丸：【用法用量】内服：15～21g，不宜入煎剂，一般研粉或入丸剂，每次5～7g（驱杀绦虫每次12～18g），饭后用温开水调服，每日3次，连服3天。榧子（A错）：【用法用量】内服：煎汤，10～15g，连壳生用，打碎入煎；嚼服，每次15g，炒熟去壳。贯众（C错）：【用法用量】内服：煎汤，5～10g；或入丸散。驱虫及清热解毒宜生用，止血宜炒炭用。地肤子（D错）：【用法用量】内服：煎汤，9～15g；或入丸散。外用：适量，煎汤熏洗，或研末敷。鹤草芽（E错）：【用法用量】内服：研粉吞服，成人每次30～50g。小儿按体重0.7～0.8g/kg，每日1次，早晨空腹服。